正中（牙合）位是指
A. 牙尖交错位
B. 肌位
C. 下颌休息位
D. 下颌后退位
E. 以上都不对

正确答案：A。牙尖交错位

解析：本题考查正中（牙合）位。牙尖交错位是指上下颌牙牙尖交错，达到最广泛、最紧密接触时下颌所处的位置，即牙尖交错（牙合）时下颌骨相对于上颌骨或颅骨的位置关系，曾称为正中（牙合）位（A对）。肌力闭合道的终点为肌接触位又称肌位（B错），正常情况下肌力闭合道的终点与牙尖交错位一致。下颌休息位当人直立或端坐，两眼平视前方，不咀嚼、不吞咽、不说话时下颌所处的位置（C错）。下颌后退位指从牙尖交错位开始，下颌还可再向后下移位少许（约1mm左右），后牙牙尖斜面保持部分接触而前牙不接触，同时髁突也受颞下颌韧带水平纤维的限制，不能再向后退，此时下颌可以作为单纯的铰链开口运动，具有可重复性，下颌所处的位置（D错）。